欲描述某省2010年鼻咽癌患者的职业构成情况，宜绘制的统计图是
A. 普通线图
B. 半对数线图
C. 直方图
D. 散点图
E. 圆图

正确答案：E。圆图

解析：直方图（C错）主要用于表示连续变量频数分布情况（P42）。线图（AB错），适用于描述一个变量随另一个变量变化的趋势和波动情况（P43）。散点图（D错）用点的密集程度和变化趋势表示两指标之间的直线或曲线关系（P47）。圆图（E对）把圆的总面积作为100%表示事物的全部，而圆内各扇形面积用来表示全体中各部分所占的比例，属于构成图。因此欲描述职业构成情况，宜绘制的统计图是圆图（E对）。